滴鼻给药，治疗鼻塞的药物是
A. 去甲肾上腺素
B. 异丙肾上腺素
C. 麻黄碱
D. 多巴胺
E. 多巴酚丁胺

正确答案：C。麻黄碱

解析：本题考查肾上腺素受体激动药和阻断药的临床应用。滴鼻给药，治疗鼻塞的药物是麻黄碱（C对）。麻黄碱激动α、β受体，收缩皮肤黏膜，肾脏及内脏血管，扩张骨骼肌血管，常用0.5%～1%的麻黄碱溶液滴鼻可消除黏膜肿胀引起的鼻塞。去甲肾上腺素（A错）临床用于抗休克和上消化道止血。异丙肾上腺素（B错）临床用于支气管哮喘、房室传导阻滞、心搏骤停、感染性休克。多巴胺（D错）用于治疗心源性休克、感染性休克和出血性休克。多巴酚丁胺（E错）用于治疗各种不同原因引起的心肌收缩力减弱的心力衰竭，临床作为短期支持治疗。